某病人因外伤致使脊髓腰1节段右侧半横断，损伤平面以下会出现
A. 右侧痛温觉丧失
B. 右侧粗触觉丧失
C. 左侧本体感觉丧失
D. 右侧本体感觉丧失
E. 左侧肢体随意运动丧失

正确答案：D。右侧本体感觉丧失

解析：脊髓内分布有支配四肢和躯干感觉的上行传导束，及支配运动功能的下行传导束。分布于脊髓的上行传导束包括薄束楔束（在脊髓不交叉至对侧，传导来自同侧躯体的本体觉和精细触觉）、脊髓丘脑侧束（因在脊髓内交叉，故上行传导对侧躯体的痛觉、温度觉）脊髓丘脑前束（部分交叉上行至对侧，传导双侧躯干四肢的粗触觉）。下行传导束主要包括皮质脊髓束，皮质脊髓束绝大部分纤维在锥体中交叉至对侧，形成锥体交叉，然后在脊髓中下行并终止于该侧的前脚运动细胞，支配该侧躯体的运动功能。该患者为脊髓右侧半横断，主要表现为右侧的随意运动（E错）、深感觉（即本体觉）（D对C错）、精细触觉障碍，左侧的痛温觉障碍（A错），而由于脊髓丘脑前束的部分交叉，故粗触觉保留（B错）。